高血压合并肾功能不全，降压药宜选
A. 血管紧张素转化酶抑制剂
B. 利尿剂
C. β受体阻滞剂
D. 血管扩张剂
E. 以上都不是

正确答案：A。血管紧张素转化酶抑制剂

解析：慢性肾功能不全合并高血压者，降压治疗的目的主要是延缓肾功能恶化，预防心、脑血管病发生，ACEI或ARB在早、中期能延缓肾功能恶化（A对）。利尿剂（B错）通过排钠，减少细胞外容量，降低外周血管阻力降低血压，特别是保钾利尿剂可引起高血钾，不宜与ACEI 、ARB 合用， 肾功能不全者慎用。β受体拮抗剂（C错）可通过抑制中枢和周围RAAS，抑制心肌收缩力和减慢心率而发挥降压作用，但对心肌收缩力、窦房结及房室结功能都有抑制作用。血管扩张剂（D错）是直接作用于外周小动脉平滑肌使阻力血管扩张，血压下降，冠心病、心力衰竭、脑血管病变或肾功能减退者慎用。